脑震荡的清醒后的表现不包括
A. 头痛
B. 头晕
C. 乏力
D. 胸闷
E. 恶心

正确答案：D。胸闷

解析：脑震荡的典型临床特点为：短暂的一过性的意识障碍，一般不超过半小时，常伴有逆行性遗忘，清醒后可出现头痛、头晕、乏力、恶心和呕吐，通常短期内会自行好转。掌握“口腔颌面部创伤急救”知识点。